人参畏
A. 官桂
B. 五灵脂
C. 朴硝
D. 丁香
E. 牵牛子

正确答案：B。五灵脂

解析：人参畏五灵脂（B对），官桂畏赤石脂（A错），硫黄畏朴硝（C错），丁香畏郁金（D错），巴豆畏牵牛（E错）。